腹腔穿刺抽出的血液凝固提示
A. 腹膜后血肿
B. 出血性胰腺炎
C. 肝、脾破裂
D. 腹腔内积血
E. 抽出为血管内血液

正确答案：E。抽出为血管内血液

解析：本题考查腹腔穿刺术。腹腔穿刺抽出的血液凝固提示抽出为血管内血液（E对），因腹膜维作用，可以使血液不凝固，如果抽出血液迅速凝固，多是由于误入血管所致。腹膜后血肿（A错）因位置深在，腹腔穿刺不易抽出液体。出血性胰腺炎（B错）、肝、脾破裂（C错）、腹腔内积血（D错）时因因腹膜维作用，可以使血液不凝固。